在判断因果联系的标准中，随着暴露剂量增加而联系强度也随之增大的是
A. 关联的一致性
B. 剂量-反应关系
C. 暴露终止效应
D. 关联的特异性
E. 关联的可重复性

正确答案：B。剂量-反应关系